关于下颌骨区X线影像，描述错误的是
A. 下颌骨的解剖形态呈弓形
B. 下颌小舌后方密度低的影像是下颌孔
C. 颌骨体内有时可见致密骨岛
D. 下颌骨主要被上颌窦占据
E. 曲面体层片则可将双侧下颌骨及颞下颌关节同时显示

正确答案：D。下颌骨主要被上颌窦占据

解析：本题考查下颌骨区X线影像。关于下颌骨区X线影像，描述错误的是下颌骨主要被上颌窦占据（D错，为本题正确答案）。下颌骨的解剖形态呈弓形。在侧斜位片上，下颌骨尖牙区与对侧下颌骨重叠，髁突则和关节窝及颈椎重叠。下颌切迹正中向下方可见一小的密度高的影像，为下颌小舌，下颌小舌后方密度低的影像是下颌孔。由下颌孔向下前方延伸至颏孔的带状密度低的阴影是下颌管，其两侧密度高的线状影像为下颌管壁的密质骨。自下颌升支前缘的下端，向前下方斜行的一条密度高的影像为外斜线，其影像常因投照角度影响而与磨牙牙根重叠。颌骨体内有时可见边缘清楚的圆形或卵圆形致密影，直径多为2～4mm，与牙根无关，此为内生骨疣，也称致密骨岛，是一种骨质生长变异，无病理意义。曲面体层片则可将双侧下颌骨及颞下颌关节同时显示。上颌骨主要被上颌窦占据。